关于主动转运的错误表述是
A. 主动转运必须借助载体或酶促系统
B. 主动转运是药物从膜的低浓度一侧向高浓度一侧转运的过程
C. 主动转运需要消耗机体能量
D. 主动转运可出现饱和现象、抑制现象
E. 主动转运有结构特异性，但没有部位特异性

正确答案：E。主动转运有结构特异性，但没有部位特异性

解析：本题考查药物的转运方式。主动转运是载体转运的一种方式，主动转运具有结构特异性和部位特异性（E错，为本题正确答案）；主动转运逆浓度梯度（B对），需借助载体或酶促系统（A对）；需要消耗能量（C对）；因为转运需借助载体，会出现饱和现象（D对）。